慢性阻塞性肺疾病变化特点的描述，错误的是
A. 黏膜上皮鳞化
B. 支气管腺体和杯状细胞增生
C. 早期病变局限于小气道
D. 肺泡间的血流量减少
E. 肺组织肉质变

正确答案：E。肺组织肉质变

解析：慢阻肺的病理改变主要表现为慢性支气管炎及肺气肿的病理变化。慢性支气管炎支气管上皮细胞变性、坏死、脱落，后期出现鳞状上皮化生（A对），杯状细胞和黏液腺肥大和增生（B对）。肺气肿镜检见肺泡壁变薄，肺泡腔扩大、破裂或形成大疱，血液供应减少（D对）。关于慢性阻塞性肺疾病早期病变，内科学认为早期病变局限于小气道（C对），病理学认为早期病变常限于较大的支气管。肺肉质变（E错，为本题正确答案）主要是由于中性粒细胞渗出过少释放的蛋白酶不足以溶解渗出物中的纤维素，大量不能被溶解吸收的纤维素被肉芽组织取代而机化，为大叶性肺炎的并发症。